下列辅料中可作为片剂润滑剂的是
A. 滑石粉
B. 活性炭
C. 两者均采用
D. 两者均不采用

正确答案：A。滑石粉

解析：本题考查片剂的常用辅料。滑石粉（A对）可作为片剂的润滑剂。广义的润滑剂按作用可以分为三类：助流剂、抗黏剂和狭义的润滑剂。常用的润滑剂（广义）有硬脂酸镁（MS）、微粉硅胶、滑石粉、氢化植物油、聚乙二醇类、十二烷基硫酸钠等。活性炭含有很多毛细孔构造，具有优异的吸附能力。用途遍及水处理、脱色、气体吸附等各个方面（BCD错）。